前庭
A. 由骨迷路和膜迷路构成
B. 位于颞骨岩部内
C. 内藏有蜗管
D. 后部有六个孔连通骨半规管
E. 前部连通耳蜗

正确答案：E。前部连通耳蜗

解析：前庭位于骨迷路的中部（AB错），近似椭圆形腔隙，长约5mm 。其前部较